关于正常产妇产后以下哪项不妥
A. 绝对卧床休息
B. 注意排尿情况
C. 观察阴道出血量
D. 早吸吮
E. 应在产房观察2小时

正确答案：A。绝对卧床休息

解析：本题考查产后的保健工作。正常产妇产后不能绝对卧床休息（A错，为本题正确答案），需要进行适当的活动，一般在产后24小时即可下床在室内活动。产后的保健工作有：应在产房观察2小时（E对）、注意孕妇的排尿情况（B对）、观察阴道出血量（C对）、将奶早吸吮（D对）等。